以小腹胀满疼痛，小便涩滞，淋沥不宣为特征的病证是
A. 热淋
B. 血淋
C. 石淋
D. 气淋
E. 劳淋

正确答案：D。气淋

解析：本题考查淋证的诊断和病证鉴别，主要记忆关键症状，如热淋的起病急，尿时灼痛（A错），血淋的尿色鲜红或淡红或夹血块而痛（B错），石淋会排除砂石（C错），气淋多有小腹胀满疼痛或小腹坠胀，小便淋漓不尽（D对），劳淋多久病，遇劳即发（E错）。